由于与口服降糖药发生相互作用而使降血糖作用减弱的药是
A. 磺胺类
B. 水杨酸类
C. 噻嗪类
D. 贝特类
E. 香豆素类

正确答案：C。噻嗪类

解析：本题考查药物相互作用。由于与口服降糖药发生相互作用而使降血糖作用减弱的药是噻嗪类（C对）。噻嗪类利尿药与抗凝药、磺酰脲类降糖药物、胰岛素合用，可减弱这些药物的作用。磺胺类（A错）、水杨酸类（B错）、贝特类（D错）、双香豆素类（E错）与血浆蛋白结合率较高的药物，通过竞争性结合可使磺酰脲类药物的游离型增多，作用加强甚至诱发低血糖反应。